某研究欲了解原发性高血压患者颈动脉内膜中层厚度IMT与尿白蛋白浓度的关系，收集了100名患者尿白蛋白浓度与IMT的数据，经计算得尿白蛋白浓度与颈动脉内膜中层厚度的相关系数r＝0.2，假设检验得P＜0.05（α＝0.05）。下列说法最合理的是
A. 可以认为IMT与尿白蛋白浓度间有轻度正相关
B. 尚不能认为IMT与尿白蛋白浓度间有相关性
C. 无法判定IMT与尿白蛋白浓度间的相关性
D. 可以认为IMT与尿白蛋白浓度间有较强相关性
E. 虽然IMT与尿白蛋白浓度间的相关有统计学意义，但实际意义不大

正确答案：E。虽然IMT与尿白蛋白浓度间的相关有统计学意义，但实际意义不大